主人体生殖的阴精是
A. 肾精
B. 天癸
C. 月水
D. 水谷之精
E. 五脏六腑之精

正确答案：A。肾精

解析：肾精是所藏先天之精与后天之精的总称，先天之精禀受于父母，主生育繁衍，又称生殖之精（A对），后天之精源于水谷精微的化生，主生长发育，又称水谷之精或脏腑之精（DE错）。天癸（B错）是肾中精气充盈到一定程度时产生的具有促进人体生殖器官成熟，并维持生殖机能的物质。月水即月经，是指有规律的周期性的子宫出血，月月如期，经常不变。规律月经的建立是生殖功能成熟的主要标志（C错）。